正常妊娠时，绒毛膜促性腺激素开始下降，是在末次月经后的
A. 4～6周
B. 8～10周
C. 12周
D. 16周
E. 20周

正确答案：C。12周

解析：正常妊娠时，绒毛膜促性腺激素出现高峰是在末次月经后的8～10周，开始下降是在12周（C对）。